诱发或加重哮喘发作
A. 利多卡因
B. 维拉帕米
C. 奎尼丁
D. 普萘洛尔
E. 胺碘酮

正确答案：D。普萘洛尔

解析：本题考查普萘洛尔。诱发或加重哮喘发作的是普萘洛尔（D对）。普萘洛尔为非选择性β受体阻断剂，非选择性的β受体阻断剂，阻断支气管平滑肌的β₂受体，引起支气管平滑肌收缩，这一作用对正常人作用弱，对支气管哮喘者作用强。因此支气管哮喘者禁用非选择性β受体阻断剂，应用选择性β₁受体阻断剂也需慎重。利多卡因（A错）Ⅰb类抗心律失常药，中枢神经系统症状有嗜睡、眩晕，过量可引起语言障碍、惊厥，甚至呼吸抑制；剂量过大可引起窦性过缓、房室阻滞等心脏毒性。维拉帕米（B错）为钙通道阻滞剂，口服给药安全，可出现便秘、腹胀、腹泻、头痛等。静脉给药可引起血压降低，甚至暂时窦性停搏。奎尼丁（C错）属于Ia类抗心律失常药，用药早期常见有胃肠道反应，长期用药可出现“金金鸡纳反应”，还可出现药物热、血小板减少等不良反应。胺碘酮（E错）是广谱抗心律失常药，常见的心血管不良反应有心动过缓、房室传导阻滞和QT间期延长等。